治疗痰瘀互结型子宫内膜异位症，首选的方剂是
A. 理冲汤合佛手散
B. 桃红四物汤合丹溪痰湿方
C. 开郁二陈汤
D. 桂枝茯苓丸
E. 苍附导痰丸合佛手散

正确答案：B。桃红四物汤合丹溪痰湿方

解析：桃红四物汤合丹溪痰湿方具有化痰散结、活血逐瘀的作用，因此可以治疗痰瘀互结型子宫内膜异位症（B对）；理冲汤具有益气行血，调经祛瘀之功效，主治妇人经闭不行，或产后恶露不尽，结为癥瘕，以致阴虚作热，阳虚作冷，食少劳嗽，虚证沓来，室女月闭血枯。佛手散主治产后血虚劳倦，盗汗，多困少力，咳嗽（A错）；开郁二陈汤有开郁行滞的功效，用于治疗形瘦、血郁、经闭（C错）；桂枝茯苓丸有活血、化瘀、消癥的功效，可缓解妇女下腹包块、月经不畅、血色暗紫、痛经、闭经、恶露不尽等症状（D错）；苍附导痰丸合佛手散有豁痰除湿，调气活血通经的功效，可以治疗多囊卵巢综合征的痰温阻滞证等（E错）。